轮班工作制对机体的效应为
A. 没有影响
B. 有益
C. 影响生物节律
D. 可引起职业病
E. 可引起肌肉骨骼疾患

正确答案：C。影响生物节律